剧烈运动状态，产热量最多的组织是
A. 脑和脊髓
B. 内脏
C. 骨骼肌
D. 甲状腺
E. 肾上腺

正确答案：C。骨骼肌